女，41岁。近一年来，月经量增多，经期延长，伴进行性痛经，且逐渐加重。体检示子宫质硬而有压痛。MRI示子宫均匀性增大。最有可能的诊断是
A. 子宫肌瘤
B. 多囊卵巢综合症
C. 痛经
D. 功能性子宫出血
E. 子宫腺肌病

正确答案：E。子宫腺肌病

解析：患者为中年女性（子宫腺肌病多见于育龄期经产妇），出现月经改变伴逐渐加重的进行性痛经（主要症状是经量过多、经期延长和逐渐加重的进行性痛经），妇检：子宫质硬而有压痛，MRI示子宫均匀性增大（妇科检查子宫呈均匀增大或有局限性结节隆起，质硬且有压痛），最可能的诊断是子宫腺肌病（E对）。子宫肌瘤（P311）（A错）多无明显症状，仅在体检时偶尔发现，常见的症状为经量增多及经期延长，无进行性痛经。多囊卵巢综合症（P360）（B错）最常见的临床表现为月经稀发或闭经，多毛、痤疮，伴有肥胖。痛经（P362）（C错）为行经前后或月经期出现下腹部疼痛、坠胀，伴有恶心、呕吐、腹泻、头晕、乏力等症状。功能性子宫出血（P344）（D错）最常见的症状是子宫不规则出血，表现为月经周期紊乱。